下列对天癸认识的叙述，错误的是
A. 天癸之源在肾
B. 随肾气的盛衰而变化
C. 决定月经的来潮和绝止
D. 受冲任二脉调节
E. 促进人体生长发育

正确答案：D。受冲任二脉调节

解析：天癸在女性生育期对冲任、胞宫发挥作用，调节冲任二脉故月事以时下，而不是受冲任二脉调节（D错，为本题正确答案）。天癸是促进人体生长、发育（E对）和生殖的一种阴精，男女都有。天癸禀受于父母，藏之于肾，所以说天癸之源在肾（A对），肾气主宰天癸的密至与竭止，天癸随肾气的盛衰而变化（B对）；天癸至则“月事以时下，故有子”，天癸竭则“地道不通，故形坏而无子也”，天癸决定月经的来潮和绝止（C对）；天癸还赖后天水谷精微滋养，在人体生长发育过程中逐渐成熟。